深龋充填时对牙髓刺激性最小的充填材料是
A. 银汞合金
B. 复合树脂
C. 磷酸锌水门汀
D. 玻璃离子水门汀
E. 聚羧酸锌水门汀

正确答案：E。聚羧酸锌水门汀

解析：本题考查深龋充填时对牙髓刺激性最小的充填材料。深龋充填时对牙髓刺激性最小的充填材料是聚羧酸锌水门汀（E对）。聚羧酸锌水门汀在固化过程中溶出物呈较强的酸性，固化24小时后，其浸泡液仍呈酸性。但由于聚丙烯酸是大分子羧酸，不易析出，而且容易与牙本质中的钙离子、胶原蛋白反应，从而很难渗入牙本质小管，因此它对牙髓的刺激性较小(小于磷酸锌水门汀（C错）和玻璃离子水门汀（D错）)，术后牙齿敏感发生率少。但是该水门汀对暴露的牙髓会引起严重的炎症，不能用于盖髓。银汞合金（A错）是热和电的良导体，其导热率远大于牙体组织，它能将冷、热、微电流传至牙髓，刺激牙髓组织产生疼痛，因此对深龋用银汞合金充填修复时应先作窝洞衬层。复合树脂（B错）充填深龋时，其固化后释放的残余单体在某些情况下对相邻的牙髓组织或牙龈会产生轻微刺激，有的甚至出现牙髓炎症反应。